生地、玄参的共同功效，除清热凉血，还有
A. 止血
B. 解毒
C. 养阴
D. 利尿
E. 化瘀

正确答案：C。养阴

解析：生地和玄参共同的功效是清热凉血，养阴（C对）；除此之外，生地还能生津，玄参还能降火、解毒（B错）、散结。地骨皮的功效是凉血除蒸，清肺降火，凉血止血（A错）。白薇的功效是清热凉血，利尿通淋（D错），解毒疗疮。牡丹皮的功效是清热凉血，活血化瘀（E错）。